声级计A声级的设计是根据
A. 模拟人耳对100方的响度曲线
B. 模拟人耳对70方的响度曲线
C. 模拟人耳对40方的响度曲线
D. 模拟人耳对1000 Hz标准音等响曲线
E. 模拟人耳对40dB纯音的响度曲线

正确答案：C。模拟人耳对40方的响度曲线

解析：本题考查声级计的设计规则。计权网络通常有“A”“B”“C”“D”等几种。A计权网络模拟人耳对40㕫（C对DE错）纯音的响应曲线，对低频段有较大幅度的衰减，对高频不衰减。B计权网络模拟人耳对70㕫纯音的响应曲线（B错），对低频音有一定程度的衰减。C计权网络模拟人耳对100㕫纯音的响应（A错）特点，对所有频率的声音几乎都同等程度地通过，故可视作总声级。D计权网络是为测量飞机噪声而设计的，可直接用于测量飞机噪声强度。